温病心烦懊恼，坐卧不安，证属
A. 热郁胆经
B. 热在肺胃
C. 邪热壅肺
D. 热扰胸膈
E. 热结肠道

正确答案：D。热扰胸膈

解析：热扰胸膈，心神不宁，则心烦懊侬，坐卧不安（D对）。热郁胆经，胆气上逆，则口苦咽干；胆气郁滞，经气不利，故胸胁满痛；胆热扰心，则心烦；胆火犯胃，胃失和降，则干呕（A错）。热在肺胃，表现为肺失宣肃，胃失合降（B错）。邪热壅肺证表现为咳喘，胸痛，痰黄黏稠（C错）。热结肠道证表现为便秘腹胀，痛而拒按（E错）。